下列乙脑后遗症，常可持续终生的是
A. 失语
B. 强直性瘫痪
C. 癫痫
D. 扭转痉挛
E. 精神失常

正确答案：C。癫痫

解析：5%～20%症患者留有后遗症，主要表现为意识障碍、痴呆、失语（A错）、肢体瘫痪（B错）、扭转痉挛（D错）和精神失常（E错）等，经积极治疗可有不同程度的恢复。癫痫痫后遗症可持续终生（C对）。